下列药物中，需检查分子量及分子量分布的是
A. 葡萄糖
B. 右旋糖酐40
C. 阿奇霉素
D. 盐酸四环素
E. 硫酸庆大霉素

正确答案：B。右旋糖酐40

解析：本题考查大分子药物的特殊检查。右旋糖酐40（B对）属于大分子，需要检查分子量。